慢性肾衰竭患者，定期血液透析，每周3次，近两天吃了2㎏橘子，出现口周麻木，四肢乏力，心率43次/分。治疗最有效的是
A. 血液透析
B. 阳离子交换树脂
C. 注射钙剂
D. 大量激素
E. 利尿剂

正确答案：A。血液透析

解析：慢性肾衰竭引起的高钾血症选用透析疗法，以血液透析为最佳，也可使用腹膜透析（A对）。经肠排钾：在肠道，阳离子交换树脂与钾交换，可清除体内钾（B错）。.选择性β₂受体激动剂用于对抗钾的心脏抑制作用(C错）。经肾排钾可选用排钾性利尿药，但肾衰竭时效果不佳（E错）。高钾血症的治疗原则无大量用激素（D错）。